边缘性骨髓炎好发于
A. 下颌骨升支
B. 下颌骨体部
C. 上颌骨体部
D. 下颌骨牙槽突
E. 下颌骨髁状突

正确答案：A。下颌骨升支

解析：边缘性颌骨骨髓炎常在颌周间隙感染基础上发生，下颌骨为好发部位；其中又以升支及下颌角部居多。边缘性颌骨骨髓炎的发病过程，也有急性与慢性之分，病变也可以是局限型或弥散型。掌握“颌骨骨髓炎”知识点。